关于遗传性乳光牙本质的说法，以下叙述正确的是
A. 釉质结构异常
B. 釉质容易脱落
C. 牙齿不易磨损
D. 病变龋坏多见
E. 牙齿磨损不显著

正确答案：B。釉质容易脱落

解析：遗传性乳光牙本质的患牙大部分病例釉质结构正常，但釉质很易剥脱，牙本质暴露后牙齿显著磨损，严重者牙被磨损至牙龈水平。病变牙中龋少见，推测是由于牙本质中龋入侵通道减少，龋被局限于牙表层，很易磨去。掌握“氟牙症、先天性梅毒牙与牙本质形成缺陷”知识点。